丹参酮ⅡA具有的作用是
A. 扩张冠脉
B. 止血
C. 润肠缓泻
D. 抑制免疫
E. 平喘

正确答案：A。扩张冠脉

解析：本题考查的是丹参的药理作用。丹参酮ⅡA具有的作用是扩张冠脉（A对）。丹参的药理作用：（1）抗心肌缺血、抗脑缺血：丹参可使心功能不良的心肌收缩力增强而不增加心肌耗氧量。丹参酮ⅡA、丹参素具有扩张冠状血管，增加冠脉流量，促进侧支循环的作用。丹参酮ⅡA能减少中性粒细胞缺血区脑组织浸润，减少炎性介质的释放，减轻脑缺血组织的炎症反应，降低血脑屏障通透性，减轻脑缺血再灌注损伤组织水肿及周围神经元和胶质细胞的破坏。（2）改善微循环：丹参能够改善微循环。丹参素可使微循环血流加快、微动脉扩张、毛细血管网开放数目增多、血液流态得到改善。（3）改善血液流变性、抗血栓：丹参有抗血液凝固作用，延长出血、凝血时间。丹参、丹参酮ⅡA和丹参素均能抑制血小板内磷酸二酯酶的活性，抑制血小板聚集。丹参还具有激活纤溶酶原作用，促进纤维蛋白转化为裂解产物，产生纤溶作用，促进血栓溶解。（4）降血脂、抗动脉粥样硬化：丹参煎剂可降低血和肝中的三酰甘油含量，降低实验动物主动脉内膜的通透性、主动脉粥样硬化面积及主动脉壁的胆固醇含量。止血（B错）为大黄的药理作用。大黄的药理作用：（1）泻下。（2）抗菌。（3）抗炎。（4）止血。润肠缓泻（C错）为决明子的药理作用。决明子主要蒽醌类成分的药理作用：决明子具有缓泻作用，也具有抗菌作用，对金黄色葡萄球菌、白色葡萄球菌、白喉杆菌、伤寒杆菌等都有较好的抗菌作用。决明子还有降脂和抗动脉粥样硬化作用等。抑制免疫（D错）为川乌的药理作用。川乌的药理作用：川乌具有镇痛、抗炎、免疫抑制、降血压及强心作用。平喘（E错）为麻黄的药理作用。麻黄的药理作用：（1）发汗。（2）平喘、镇咳、祛痰。（3）利尿。（4）解热、镇痛、抗炎。